某女，49岁。形体消瘦，口干咽燥，不欲饮水；舌光红无苔，脉细数。辨析其病机是
A. 阴阳两虚
B. 气虚
C. 津液亏虚
D. 血虚
E. 气血两虚

正确答案：C。津液亏虚

解析：本题考查津液不足的病机。患者形体消瘦，口干咽燥，不欲饮水；舌光红无苔，脉细数。辨析其病机是津液亏虚（C对）。津液不足：津液不足，是指津液在数量上的亏少，进而导致内则脏腑，外而孔窍、皮毛，失其濡润滋养作用，因之产生一系列干燥失润的病机变化。多由燥热之邪或五志之火，或发热、多汗、吐泻、多尿、失血，或过用误用辛燥之剂等引起津液耗伤所致。常见口、鼻、皮肤干燥，大吐、大泻、多尿时所出现的目陷、螺瘪，甚则转筋等；热病后期或久病伤阴，所见到的舌光红无苔或少苔、唇舌干燥而不引饮、形瘦肉脱、肌肤毛发枯槁，甚则肌肉、手足震颤蠕动等临床表现。阴阳互损：阴阳互损，是指阴或阳任何一方虚损到相当程度，病变发展影响及相对的一方，形成阴阳两虚（A错）的病变机制。虚劳之气虚（B错）证【症状】面色㿠白或萎黄，气短懒言，语声低微，头昏神疲，肢体无力。舌淡，或有齿痕，舌苔薄白，脉虚无力。血虚（D错）：血虚，是指血液不足或血的濡养功能减退的病机变化。失血过多，新血来不及生成，或脾胃虚弱，饮食营养不足，化生血液的功能减弱或化源不足，而致血液化生障碍，或因久病不愈、慢性消耗等因素而致营血暗耗等，均可导致血虚。在血虚时，就会出现全身或局部的失荣失养，功能活动逐渐衰退等虚弱的证候。例如，面色不华，唇舌爪甲色淡无华，头目眩晕，心悸怔忡，神疲乏力，形体瘦怯，或手足麻木，关节屈伸不利，或两目干涩，视物昏花等。崩漏之气血两虚（E错）证【症状】出血量多或淋沥不尽，血色淡薄，面色无华，气短懒言，食欲不振，便溏。舌质淡，苔薄白湿润，脉细弱。